颅内压增高时，何结构被挤人小脑幕切迹与中脑之间，形成脑疝
A. 小脑半球
B. 海马旁回
C. 绒球
D. 小脑扁桃体
E. 无

正确答案：B。海马旁回

解析：颅内压增高时，被挤入小脑幕切迹与中脑之间的结构为小脑幕切迹上方的海马旁回（B对）；小脑半球（A错）位于小脑两侧；绒球（C错）位于小脑半球前缘；小脑扁桃体（D错）在小脑半球下面的前内侧。